用通利药治疗具有通泄症状的实证，其治则是
A. 实者泻之
B. 虚者补之
C. 通因通用
D. 塞因塞用
E. 攻补兼施

正确答案：C。通因通用

解析：通因通用是指用通利方药或具有通利功效的措施来治疗具有通泻症状的治法（C对）。实则泻之指用攻伐方药或具有攻伐功效的措施而治疗实性病证的治法（A错）。虚则补之指用补益方药或具有补益功效的措施而治疗虚性病证的治法（B错）。塞因塞用即以补开塞，是指用补益固涩方药或具有补益、固涩功效的措施来治疗具有闭塞不通症状的治法（D错）。扶正与祛邪的同时使用，即攻补兼施，适用于正虚邪实、虚实错杂，但二者均不甚重的虚实夹杂的病证（E错）。